属于渗透性泻药的是
A. 甘油
B. 聚乙二醇4000
C. 乳果糖
D. 比沙可啶
E. 硫酸镁

正确答案：C。乳果糖

解析：本题考查泻药。乳果糖（C对）系人工合成的不吸收性双糖，是一种渗透性泻药，具有双糖的渗透活性；甘油（A错）为润滑性泻药；聚乙二醇4000（B错）为膨胀性泻药；比沙可啶（D错）为刺激性泻药；硫酸镁（E错）为容积性泻药。